工具的外型设计应符合
A. 人体尺寸和人的解剖及生理特点
B. 工作姿势的要求
C. 人的心理特点及要求
D. 人的生理特点及要求
E. 美观大方的原则

正确答案：A。人体尺寸和人的解剖及生理特点